男孩，10个月，因高热7天伴皮疹来院。查体：发育正常，皮肤可见红色斑疹，右颈部淋巴结1.5cm×2cm，咽红，扁桃体Ⅰ度，口唇干红，双肺呼吸音清，心尖区可闻及2/6SM，腹软，肝、脾不大，四肢末端红肿。实验室检査：HB100g/L，WBC13×109/L，N0.78，L0.22，PLT352×109/L，ESR70mm/h，ERP（+），ASO100U。该患儿外周血常规显示血小板升高，进一步可用哪些药物
A. 血浆置换
B. 环磷酰胺
C. 糖皮质激素
D. 双嘧达莫
E. 以上都不是

正确答案：D。双嘧达莫

解析：对于川崎病患儿，除使用阿司匹林外，还可加用其他抗凝药物，如潘生丁可减轻血小板凝集和血管炎症反应。掌握“川崎病”知识点。